治疗鹅口疮心脾积热证，应首选
A. 凉膈散
B. 泻黄散
C. 清热泻脾散
D. 泻心导赤散
E. 知柏地黄丸

正确答案：C。清热泻脾散

解析：凉膈散可用于治疗口疮风热乘脾证，散风清热，祛火清疮（A错）。泻黄散可合泻心导赤散用于治疗口疮心火上炎证，功能泻脾胃伏火（B错）。鹅口疮心脾积热证治宜清心泻脾，泻火清疮，方选清热泻脾散（C对）。泻心导赤散为治疗口疮心火上炎证的选方，功能清心凉血，泻火解毒（D错）。知柏地黄丸为治疗鹅口疮虚火上浮证的选方，功能滋阴降火（E错）。